6周岁的小儿的标准体重、身高按现行公式计算应为
A. 12公斤、85厘米
B. 14公斤、105厘米
C. 16公斤、110厘米
D. 18公斤、115厘米
E. 20公斤、112厘米

正确答案：E。20公斤、112厘米

解析：本例儿童年龄为6岁>2岁，故可以运用上述公式，身高（cm）=7×6+75=117（旧教材公式：身高（cm）=5×6+75=105或身高（cm）=7×6+70=112），体重（kg）=8+2×6=20，由于本题出题年份较早，故身高按照旧公式可得该儿童的标准体重、身高为20kg，112cm（E对）。